将特定人群按其是否暴露于某因素分为两组，追踪观察一定时间，比较两组的发病率，以检验该因素与某疾病联系的假设属于哪种调查方法
A. 病例-对照研究
B. 群组研究
C. 横断面研究
D. 常规资料分析
E. 纵向研究

正确答案：B。群组研究

解析：本题考查群组研究的定义。将特定人群按其是否暴露于某因素分为两组，追踪观察一定时间，比较两组的发病率，以检验该因素与某疾病联系的假设属于群组研究（B对）。群组研究的研究时间较长，尤其对慢性病的观察费时更多。病例-对照研究（A错）的特点是观察时间短、需要研究的对象少，适合研究一些病程较长的慢性病和一些比较少见的疾病。横断面研究（C错）又称现况调查，调查目标人群中某种疾病或现象在某一特定时点的情况。常规资料分析（D错）又称历史资料分析，即对已有的资料或者疾病监测记录做分析或总结。纵向研究（E错）又称疾病监测，即研究疾病或某种情况在一个人群中随着时间推移的自然动态变化。